患儿5岁。8月10日开始发热，头痛，恶心呕吐一次，次日稀便三次，精神不振，抽搐一次。体检：急性热病容，嗜睡状，颈强（+），克氏征（++），WBC15.2×10⁹/L，脑脊髓液为无色透明，白细胞100×10⁹/L，中性80%。该患儿住院二天后，高热不退，反复抽搐，意识不清，呼吸节律不整，此时最重要的抢救措施是立即应用
A. 脱水剂
B. 呼吸兴奋剂
C. 地塞米松
D. 退热剂
E. 镇静剂

正确答案：A。脱水剂

解析：流行性乙型脑炎是由乙脑病毒引起的血液传染病，多见于夏秋季，10岁以下儿童发病率最高，临床上起病急，体温急剧上升至39～40℃，伴头痛、恶心和呕吐，部分病人有嗜睡或精神倦怠，并有颈项强直、深反射亢进、病理性锥体束征阳性等表现，实验室检查：（1）血象 白细胞总数常在10000～20000/mm3，中性粒细胞在80%以上；（2）脑脊液呈无色透明，压力仅轻度升高，白细胞计数增加，在50～500/mm3，病初以中性粒细胞为主。该患儿5岁。8月10日开始发热，头痛，恶心呕吐一次，次日稀便三次，精神不振，抽搐一次。体检：急性热病容，嗜睡状，颈强（+），克氏征（++），WBC15.2×10⁹/L，脑脊髓液为无色透明，白细胞100×10⁹/L，中性80％等表现符合流行性乙型脑炎，如患儿住院二天后，高热不退，反复抽搐，意识不清，呼吸节律不整，提示该患儿出现了脑水肿和颅内压增高，此时应严格限制液体入量和（或）静脉注射脱水剂（A对），如甘露醇、呋塞米等。呼吸兴奋剂（B错）属于中枢兴奋药，主要通过直接兴奋延髓呼吸中枢，也可通过刺激颈动脉体和主动脉体的化学感受器反射性的兴奋呼吸中枢，使呼吸加深加快，通气量增加，提高血氧分压。地塞米松（C错）是肾上腺糖皮质激素，可用于抗炎、抗过敏、抗毒及抗休克等。退热剂（D错）常用于发热时达到降低体温的作用。镇静剂（E错）可用于惊厥、癫痫等的患儿，以达到镇静的作用。